用以衡量疾病对人生命威胁的严重程度
A. 引入率
B. 续发率
C. 死亡率
D. 病死率
E. 发病率

正确答案：D。病死率